某女，55岁。近来因关节疼痛、屈伸不利而服用祛风止痛片，但其求愈心切，自行将单次剂量增加到2倍。服药7日后，出现口舌麻木、头晕、心悸气短等症状。分析上述症状是由过量服用祛风止痛片所致，原因是其药物组成中含有
A. 蟾酥
B. 马钱子
C. 制草乌
D. 雄黄
E. 细辛

正确答案：C。制草乌

解析：本题考查的是乌头类药物的中毒表现。近来因关节疼痛、屈伸不利而服用祛风止痛片，但其求愈心切，自行将单次剂量增加到2倍。服药7日后，出现口舌麻木、头晕、心悸气短等症状。分析上述症状是由过量服用祛风止痛片所致，原因是其药物组成中含有制草乌（C对）。乌头类药物和含乌头类药物的中成药：1.中药材：川乌、草乌、附子、雪上一枝蒿等。2.中成药：追风丸、追风透骨丸、三七伤药片、附子理中丸、金匮肾气丸、木瓜丸、小金丸、风湿骨痛胶囊、祛风止痛片、祛风舒筋丸、正天丸、右归丸等。中毒表现：1.神经系统：表现为口舌、四肢及全身麻木，头痛，头晕，精神恍惚，语言不清或小便失禁，继而四肢抽搐、牙关紧闭、呼吸衰竭等。2.循环系统：表现为心悸气短、心律失常、血压下降、面色苍白、口唇发绀、四肢厥冷等。3.消化系统：表现为流涎、恶心、呕吐、腹痛、腹泻、肠鸣音亢进。含蟾酥（A错）的中成药：六神丸、六应丸、喉症丸、梅花点舌丸、麝香保心丸、麝香通心滴丸等。中毒表现：1.循环系统：表现为胸闷、心律失常、脉缓慢无力、心电图显示房室传导阻滞等。严重时面色苍白、口唇发绀、四肢厥冷、大汗虚脱、血压下降、休克，甚至心搏骤停而死亡。2.消化系统：表现为恶心呕吐、腹痛、腹泻等。含马钱子（B错）的中成药：九分散、山药丸、舒筋丸、疏风定痛丸、伤科七味片等。中毒表现：初期出现头晕、头痛、烦躁不安、面部肌肉紧张、吞咽困难；进而伸肌与屈肌同时做极度收缩，发生典型的士的宁惊厥、痉挛，甚至角弓反张，可因呼吸肌痉挛窒息或心力衰竭而死亡。含雄黄（D错）的中成药：牛黄解毒丸（片）、六神丸、喉症丸、安宫牛黄丸、牛黄清心丸、牛黄镇惊丸、牛黄抱龙丸、牛黄至宝丸、追风丸、牛黄醒消丸、紫金锭（散）、三品等。中毒表现：1.消化系统表现为口腔咽喉干痛、烧灼感，口中有金属味，流涎，剧烈恶心呕吐、腹痛腹泻，严重时类似霍乱。2.各种出血症状，如吐血、咯血、眼结膜充血、鼻衄、便血、尿血等。3.肝肾功能损害而引起转氨酶升高、黄疸、血尿、蛋白尿等。4.严重者因心力衰竭、呼吸衰竭而死亡。5.长期接触可引起皮肤过敏，出现丘疹、疱疹、痤疮样皮疹等。细辛（E错）的不良反应表现：细辛中的挥发油直接作用于中枢神经系统，最终可因呼吸中枢完全麻痹而致死。细辛的急性毒性对小鼠肺、肝、肾等重要脏器均有明显损害，其中对肺脏的病理损害最为严重。细辛中毒时，常可出现头痛、呕吐、出汗、口渴、烦躁不安、面赤、呼吸急促、脉数、瞳孔散大，体温血压均升高；个别出现心慌、气短、胸闷，动则加重，窦性心动过速及双下肢水肿等急性心力衰竭症状，或精神紧张，失眠，胆小易惊，心悸、濒死感，面色萎黄灰暗，多发性阵发性窦性心动过速等心律失常伴自主神经紊乱等。严重者可出现牙关紧闭、角弓反张、意识不清、四肢抽搐、尿闭，最后因呼吸麻痹而死亡。